禁止生产经营下列食品，但不包括
A. 超过保质期限的
B. 加入药物的
C. 掺假、掺杂、伪造，影响营养卫生的
D. 病死、毒死或者死因不明的禽、畜、兽，水产动物等及其制品
E. 未经兽医卫生检验或者检验不合格的肉类及其制品

正确答案：B。加入药物的